混凝剂净水的主要作用是
A. 它是不带电荷的胶体，能促使水中不带电荷的胶体颗粒自动凝聚
B. 它是带电荷的胶体，能促使水中不带电荷的胶体颗粒自动凝聚
C. 它是带正电荷的胶体，能与水中带负电荷胶体颗粒凝聚
D. 它是带两性电荷的胶体，能与水中胶体颗粒凝聚
E. 它是带负电荷的胶体，和水中带负电荷胶体颗粒凝聚

正确答案：C。它是带正电荷的胶体，能与水中带负电荷胶体颗粒凝聚

解析：本题考查混凝剂净水的主要作用。混凝剂净水的主要作用是：它是带正电荷的胶体，能与水中带负电荷胶体颗粒凝聚（C对ABDE错）。